诊断病毒性心肌炎最常做的检查是
A. 心脏彩色多普勒检查
B. 心电图
C. 心电向量
D. 胸部X线摄片
E. 螺旋CT

正确答案：B。心电图

解析：诊断病毒性心肌炎最常做的检查是心电图。心电图改变∶以R波为主的2个或2个以上的主要导联（Ⅰ、Ⅱ、aVF、V）的ST-T改变持续4天以上伴动态变化，窦房传导阻滞、房室传导阻滞，完全性右或左束支阻滞，成联律、多形、多源、成对或并行性期前收缩，非房室结及房室折返引起的异位性心动过速，低电压（新生儿除外）及异常Q波（B对）。心脏彩色多普勒检查主要是对心脏内的血流方向和速度进行测定，并根据结果评估心室收缩和舒张功能，瓣膜有无狭窄或关闭不全（A错）。心电向量是各瞬间产生的电激动在立体的方向及大小的一种特殊检查（C错）。胸部X线摄片心脏及大血管病变，如肺充血、肺缺血、先心病、肺动脉高压、主动脉夹层等； 2、肺胸部及支气管病变，肺部炎症、气胸、肺部肿瘤性病变等（D错）。螺旋CT通过造影可查明占位性病变如肿瘤、囊肿、增大的淋巴结、血肿、脓肿和肉芽肿的大小、形态、数目和侵犯范围，它可以决定某些器官癌肿的分期和是否能进行手术切除（E错）。